《药品经营质量管理规范》，药品批发企业应当根据相关验证管理制度，形成的验证控制文件包括
A. 验证方案
B. 验证报告
C. 验证评价
D. 偏差处理
E. 预防措施

正确答案：A、B、C、D、E。验证方案；验证报告；验证评价；偏差处理；预防措施

解析：本题考查的是药品批发企业验证控制文件与验证报告。《药品经营质量管理规范》，药品批发企业应当根据相关验证管理制度，形成的验证控制文件包括验证方案（A对）、验证报告（B对）、验证评价（C对）、偏差处理（D对）与预防措施（E对）。药品批发企业验证控制文件与验证报告：企业应当根据相关验证管理制度，形成验证控制文件，包括验证方案、报告、评价、偏差处理和预防措施等。验证应当按照预先确定和批准的方案实施，验证报告应当经过审核和批准，验证文件应当存档。企业应当根据验证确定的参数及条件，正确、合理使用相关设施设备。